某患者突发呼吸困难，吸气时胸骨上窝、锁骨上窝和肋间隙明显凹陷，临床诊断可能是
A. 左心功能不全
B. 右心功能不全
C. 肺气肿
D. 气管异物
E. 大块肺梗死

正确答案：D。气管异物

解析：患者突发呼吸困难，且有典型的三凹征（吸气时胸骨上窝、锁骨上窝和肋间隙明显凹陷），临床诊断气管异物（D对）。左心功能不全（A错）以肺循环淤血及心排血量降低为主要表现，可有不同程度的呼吸困难，不会出现三凹征，常有慢性病史。右心功能不全（B错）以体循环淤血为主要表现，常见症状为胃肠道及肝淤血引起的腹胀、食欲不振、恶心、呕吐等，也有明显的呼吸困难，但也不会出现"三凹征"。肺气肿（C错）时肺容积增大，肋间隙饱满，而不会出现“三凹征”。大块肺梗死（E错）患者常见表现为三联征，即呼吸困难、胸痛、咯血。